《中国药典》（2005）版将生物制品列入
A. 第一部
B. 第二部
C. 第三部
D. 第一部附录
E. 第二部附录

正确答案：C。第三部